肾功能不全者忌用
A. 甘草
B. 麻黄
C. 黄药子
D. 马兜铃
E. 麦芽

正确答案：D。马兜铃

解析：本题考查的是证候禁忌。肾功能不全者忌用马兜铃（D对）。证候禁忌：是指某类或某种中药不适用于某类或某种证候，在使用时应予以避忌的，又名病证禁忌。凡药不对证，即药物的性能功效与所疗疾病的病证相悖，有可能导致病情加重、恶化者，原则上都属于禁忌范围。如体虚多汗者，忌用发汗药，以免加重出汗而伤阴津。阳虚里寒者，忌用寒凉药，以免再伤阳生寒。阴虚内热者，慎用苦寒清热药，以免苦燥伤阴。脾胃虚寒、大便稀溏者，忌用苦寒或泻下药，以免再伤脾胃。阴虚津亏者，忌用淡渗利湿药，以免加重津液的耗伤。火热内炽和阴虚火旺者，忌用温热药，以免助热伤阴。妇女月经过多及崩漏者，忌用破血逐瘀之品，以免加重出血。脱证神昏者，忌用香窜的开窍药，以免耗气伤正。邪实而正不虚者，忌用补虚药；湿热泻痢者，忌用涩肠止泻药，以免闭门留邪。表邪未解者，忌用固表止汗药，以免表邪入里化热。又如体虚多汗者忌用发汗力较强的麻黄（B错）；虚喘、高血压及失眠患者，慎用麻黄；湿盛胀满、水肿患者，忌用甘草（A错）；麻疹已透及阴虚火旺者，忌用升麻；有肝功能障碍者，忌用黄药子（C错）；肾病患者忌用马兜铃；授乳期妇女不宜大量使用麦芽（E错）等。